《中国药典》规定，中药饮片中药屑及杂质不得过
A. 0.01
B. 0.03
C. 0.05
D. 0.07
E. 0.1

正确答案：B。0.03

解析：本题考查杂质检查。中药中杂质的混存，直接影响药材的纯度，这些杂质的存在将直接影响中药的质量和使用，降低临床疗效，若含有有毒杂质还会危及患者生命安全，故对中药中的杂质必须加以限量检查，如《中国药典》规定药屑杂质通常不得过3%（B对）。